干性支气管扩张是指
A. 反复咯血无咳嗽、咳痰，其发生部位引流不畅
B. 反复咯血无咳嗽、咳痰，其发生部位引流良好
C. 反复痰中带血但痰极少，其发生部位引流良好
D. 反复咳嗽、大量脓血痰，其发生部位多位于下叶
E. 反复咯血、干咳，其发生部位多位于右下基底段

正确答案：B。反复咯血无咳嗽、咳痰，其发生部位引流良好

解析：50%～70%的支气管扩张患者有程度不等的咯血，从痰中带血至大量咯血，咯血量与病情严重程度、病变范围有时不一致。部分患者以反复咯血为唯一症状，无咳嗽、咳痰等（CDE错），临床上称为干性支气管扩张，其病变部位多位于引流良好的上叶支气管（A错），故干性支气管扩张是指反复咯血、无咳嗽、咳痰，其发生部位引流良好的支气管扩张（B对）。